藏药七味红花殊胜丸的功能是
A. 清热消炎，保肝退黄
B. 清热解毒，疏肝利胆
C. 清热解毒，益肝养胃
D. 清热解毒，调和滋补
E. 清热消炎，通经活络

正确答案：A。清热消炎，保肝退黄

解析：本题考查的是七味红花殊胜丸的功能。藏药七味红花殊胜丸的功能是清热消炎，保肝退黄（A对）。七味红花殊胜丸的功能与主治：清热消炎，保肝退黄。用于新旧肝病，巩膜黄染，食欲不振等。清热解毒，疏肝利胆（B错）为二十五味松石丸功能。二十五味松石丸的功能与主治：清热解毒，疏肝利胆，化痰。用于肝郁气滞，血瘀，肝中毒，肝痛，肝硬化，肝渗水及各种急、慢性肝炎和胆囊炎。清热解毒，益肝养胃（C错）为仁青芒觉的功能。仁青芒觉的功能与主治：清热解毒，益肝养胃，明目醒神，愈疮，滋补强身。用于自然毒、食物毒、配制毒等各种中毒症；“培根木布”，消化道溃疡，急慢性胃肠炎，萎缩性胃炎，腹水，麻风病等。清热解毒，调和滋补（D错）为仁青常觉的功能。仁青常觉的功能与主治：清热解毒，调和滋补。用于“隆、赤巴、培根”各病，陈旧性胃肠炎、溃疡，“木布”病，萎缩性胃炎，各种中毒症；梅毒，麻风，陈旧热病，炭疽，疖痛，干黄水，化脓等。功能为清热消炎，通经活络（E错）的藏药，2022年考试指南未明确说明。